常用于吸附水溶液中非极性色素的是
A. 阳离子交换树脂
B. 透析膜
C. 活性炭
D. 硅胶
E. 氧化铝

正确答案：C。活性炭

解析：本题考查的是活性炭的性质。常用于吸附水溶液中非极性色素的是活性炭（C对）。活性炭吸附色谱法：活性炭是非极性吸附剂，与硅胶（D错）、氧化铝（E错）相反，对非极性物质具有较强的亲和能力，在水中对溶质表现出强的吸附能力。在结晶及重结晶过程中加入活性炭进行的脱色、脱臭等操作，这在物质精制过程中应用很广。通常拟除去的色素是亲脂性的，活性炭脱色会有良好的效果；如果色素是亲水性，效果会差很多，因此，活性炭脱色需根据预试结果先判断色素的类型，再决定选用什么吸附剂处理为宜。阳离子交换树脂（A错）为离子色谱法的固定相。离子色谱法是根据物质解离程度不同进行分离。离子色谱法也称离子交换法，该法系以离子交换树脂作为固定相，以水或含水溶剂作为流动相。中药化学成分中，具有酸性、碱性及两性基团的分子，在水中多呈解离状态，据此可用离子交换法或电泳技术进行分离。透析膜（B错）应用于膜分离法中。膜分离法是一种用天然或人工合成的膜，以外界能量或化学位差为推动力，对双组分或多组分的溶质和溶剂进行分离、分级、提纯或富集的方法。对于生物大分子，一般可以通过透析法对其进行浓缩和精制。